（131～132题共用题干）男，25岁。右胫前红肿2天，畏寒、发热1天。局部表皮发红，微隆起，指压稍褪色，边界清，右腹股沟淋巴结肿痛。最可能的诊断是
A. 痈
B. 气性坏疽
C. 疖
D. 丹毒
E. 急性蜂窝织炎

正确答案：D。丹毒

解析：该患者右胫前红肿2天，畏寒、发热1天。局部表皮发红，右腹股沟淋巴结肿痛（畏寒、发热、附近淋巴结常肿大、有触痛为丹毒的早期表现）。综合患者病史、症状、体征，应诊断为丹毒（D对）。痈（P108）（A错）一般以中老年人发病居多，部分病人原有糖尿病。病变好发于皮肤较厚的部位，如在项部和背部，俗称“对口疔”和“搭背”。疖（P108）（C错）好发于颈项、头面和背部，与局部皮肤不洁、擦伤、皮下毛囊与皮脂腺分泌物排泄不畅或机体抵抗力降低有关。急性蜂窝织炎（P110）（E错）表浅者初起时患处红、肿、热、痛，继之炎症迅速沿皮下向四周扩散，肿胀越发明显，并出现不同大小的水疱、疼痛更加剧烈，此时局部皮肤发红、指压后可稍褪色，红肿边缘界限不清楚。气性坏疽（P119）（B错）的临床特点是病情极度恶化，烦躁不安，夹有恐惧或欣快感；皮肤、口唇变白，大量出汗、脉搏快速、体温逐步上升。